女性淋菌性腹膜炎的常见感染途径
A. 直接扩散
B. 上行性感染
C. 透壁性感染
D. 血行播散
E. 淋巴感染

正确答案：B。上行性感染

解析：女性淋菌性腹膜炎的常见感染途径是上行性感染（B对）。直接扩散（A错）一般见于累及周围器官。透壁性感染（C错）一般可见于肝硬化、肾病等疾病导致的腹膜炎的感染途径。血行播散（D错）可见于淋病奈瑟菌感染身体泌尿系统其他部位。淋巴感染（E错）一般不是淋病奈瑟菌的感染途径。